患者男，64岁，患急性心肌梗死，心胸剧痛，持续难解，心悸气短，神疲乏力，自汗盗汗，手足心热，口渴心烦，面色苍白，舌质紫暗，脉细数无力，其治法是
A. 益气养阴，祛瘀通络
B. 益气温阳，祛瘀活血
C. 益气温阳，宣痹散寒
D. 益气养阴，祛痰开窍
E. 益气温阳，活血通络

正确答案：A。益气养阴，祛瘀通络

解析：患者患急性心肌梗死，心胸剧痛，持续难解，心悸气短，神疲乏力，面色苍白为气虚症状。自汗盗汗，手足心热，口渴心烦为阴虚症状。舌质紫暗，脉细数为血瘀为气阴两虚兼血瘀之证，故治法为益气养阴，祛瘀通络（A对）。寒凝血瘀证治法益气温阳，祛瘀活血（B错）。寒凝心脉证治法益气温阳，宣痹散寒（C错）。气阴两虚兼痰瘀互结证治法益气养阴，祛痰开窍（D错）。阳虚血瘀证治法益气温阳，活血通络（E错）。